具有苯并咪唑结构特征可抑制H⁺/K⁺-ATP酶，以光学活性异构体上市的抗溃疡药是
A. 法莫替丁
B. 盐酸雷尼替丁
C. 雷贝拉唑钠
D. 泮托拉唑
E. 埃索美拉唑

正确答案：E。埃索美拉唑

解析：本题考查埃索美拉唑。奥美拉唑为具有苯丙咪唑的结构的H⁺，K⁺-ATP酶抑制剂，埃索美拉唑（E对）为奥美拉唑的S-异构体，现已上市；法莫替丁（A错）、盐酸雷尼替丁（B错）均可阻断组胺H₂受体，可逆性竞争壁细胞基底膜上的H₂受体，显著抑制胃酸分泌，属于组胺H₂受体阻断剂；雷贝拉唑钠（C错）、泮托拉唑（D错）属于H⁺，K⁺-ATP酶抑制剂，是具有苯丙咪唑结构的抑酸抗溃疡药物，但上市药物不是光学异构体。